关于腋动脉的描述正确的是
A. 于第1肋外侧缘续锁骨下动脉
B. 在大圆肌下缘处移行为肱动脉
C. 被胸小肌分为三段
D. 在腋窝内被臂丛的束和主要分支包围
E. 以上全对

正确答案：E。以上全对

解析：腋动脉在第1肋的外侧缘续于锁骨下动脉，在大圆肌下缘处移行为肱动脉，被胸小肌分为三段，在腋窝内被臂丛的束和主要分支包围（ABCD对，故E为本题正确答案）。